位于尿生殖膈内
A. 睾丸
B. 附睾
C. 精囊腺
D. 前列腺
E. 尿道球腺

正确答案：E。尿道球腺

解析：尿道球腺（E对）位于会阴深横肌内，会阴深横肌和尿道括约肌共同组成尿生殖膈，故尿道球腺位于尿生殖膈内。